在酵解过程中催化产生NADH和消耗无机磷酸的酶是
A. 乳酸脱氢酶
B. 3-磷酸甘油醛脱氢酶
C. 醛缩酶
D. 丙酮酸激酶
E. 烯醇化酶

正确答案：B。3-磷酸甘油醛脱氢酶

解析：本题考查糖的无氧氧化。在酵解过程中催化产生NADH和消耗无机磷酸的酶是3-磷酸甘油醛脱氢酶（B对）。乳酸脱氢酶（A错）催化丙酮酸还原乳酸，消耗NADH。醛缩酶（C错）催化果糖-1,6-二磷酸裂解成2分子磷酸丙糖。丙酮酸激酶（D错）催化磷酸烯醇式丙酮酸将高能磷酸键转移给ADP生成ATP和斌酮酸。烯醇化酶（E错）催化20磷酸甘油酸脱水生成磷酸烯醇式丙酮酸。